对耐青霉素和头孢菌素类革兰氏阳性杆菌严重感染有效的抗生素为
A. 哌拉西林
B. 氨曲南
C. 阿莫西林
D. 万古霉素
E. 庆大霉素

正确答案：D。万古霉素

解析：本题考查万古霉素。万古霉素（D对）对革兰氏阳性菌具有强大的抗菌活性，对炭疽杆菌、白喉棒状杆菌、破伤风杆菌高度敏感，可用于使用青霉素、头孢菌素类后治疗无效时的革兰氏阳性菌的严重感染。哌拉西林（A错）、阿莫西林（C错）属于青霉素类抗生素。氨曲南（B错）用于敏感需氧革兰氏阴性菌所致的感染。庆大霉素（E错）用于敏感革兰氏阴性菌造成的感染。